直肠指诊摸到不平质硬肿物，有脓血与黏液，考虑诊断为
A. 直肠癌
B. 直肠息肉
C. 内痔
D. 肛瘘
E. 肛裂

正确答案：A。直肠癌

解析：指诊摸到不平质硬肿物，有脓血与黏液，考虑诊断为直肠癌（A对）。指诊触及柔软、光滑而有弹性的包块常为直肠息肉（B错）。若触及圆形柔软的血管团为内痔（C错）。能够扪到硬结样内口及条索样瘘管为肛瘘（D错）。指诊时有强烈触痛的考虑为肛裂（E对）。